川木通的原植物属于
A. 毛茛科
B. 木通科
C. 豆科
D. 马兜铃科
E. 茜草科

正确答案：A。毛茛科

解析：本题考查的是川木通的来源。川木通的原植物属于毛茛科（A对）。川木通：【来源】本品为毛茛科植物小木通或绣球藤的干燥藤茎。大血藤：【来源】为木通科（B错）植物大血藤的干燥藤茎。来源于豆科（C错）的中药有葛根、甘草、黄芪、鸡血藤、降香、合欢皮、番泻叶、槐花等。来源于马兜铃科（D错）的中药有马兜铃、细辛等。来源于茜草科（E错）的中药有巴戟天、茜草、钩藤、栀子、白花蛇舌草等。